不属于医学伦理学原则的是
A. 有利
B. 公正
C. 不伤害
D. 克己
E. 尊重

正确答案：D。克己

解析：“四原则说”由比彻姆和查尔瑞斯在其合著的《生物医学伦理学原理》一书中提出和阐释。他们认为，自主原则、不伤害（C对）原则、行善原则、公正（B对）原则是生命伦理的基本原则。生命伦理四原则传入我国后，逐渐成为教科书中的主要内容，并被列为国家医师资格考试的内容，所不同的是，其中的自主原则被改称为尊重（E对）原则，行善原则被改称为有利（A对）或有益原则。因此，医学伦理学原则包括有利原则、公正原则、不伤害原则和尊重原则，不包括克己（D错，为本题正确答案）原则。